食物发生酸度升高、产气、带有甜味、有醇类气味的变质过程为
A. 油脂酸败
B. 蛋白质分解
C. 碳水化合物分解
D. 美拉德反应
E. 醇类发酵

正确答案：C。碳水化合物分解

解析：本题考查碳水化合物分解。食物发生酸度升高、产气、带有甜味、有醇类气味的变质过程为碳水化合物的分解（C对ABDE错）。